相乘可称为
A. 相生
B. 相克
C. 过克
D. 反克
E. 制化

正确答案：C。过克

解析：本题考查的是五行的生克乘侮。相乘可称为过克（C对）五行相乘，是指五行的某一行对所胜一行克制太过，从而引起一系列的异常相克反应，也称为“过克”。五行相生（A错），是指木、火、土、金、水之间存在着有序的资生、助长和促进的作用。五行相克（B错），是指木、土、水、火、金之间存在着有序的克制、制约的作用。五行反克（D错），即五行相侮。五行相侮，是指由于五行的某一行对所不胜一行进行反向克制，又称“反侮”或“反克”。五行制化（E错），2022年考试指南未明确说明。